对于不符合静脉溶栓适应证的非心源性栓塞性缺血性脑卒中，宜选用的药物是
A. 达比加群酯
B. 氯吡格雷
C. 尿激酶
D. 依诺肝素钠
E. 华法林

正确答案：B。氯吡格雷

解析：本题考查氯吡格雷。治疗非心源性栓塞性缺血性脑卒中，宜选用的药物是氯吡格雷（B对）。氯吡格雷用于近期心肌梗死（从几天到小于35天）、近期缺血性卒中（从7天到小于6个月）、非心源性栓塞性缺血性脑卒中或确诊外周动脉性疾病及急性冠脉综合征，非ST段抬高性急性冠脉综合征（包括不稳定性心绞痛或非Q波心肌梗死）。达比加群酯（A错）用于预防非瓣膜性房颤患者的卒中和全身性栓塞。尿激酶（C错）临床用于深静脉血栓的溶栓治疗。依诺肝素钠（D错）用于预防静脉栓塞性疾病，尤其与某些手术有关的栓塞；也用于血液透析体外循环中，防止血栓形成等。华法林（E错）适用于预防、治疗深静脉血栓及肺栓塞，预防心肌梗死后、心房颤动、心瓣膜疾病或人工瓣膜置换术后引起的血栓栓塞并发症。